嘌呤核苷酸从头合成的原料不包括
A. R-5'-P
B. 一碳单位
C. 天冬氨酸、甘氨酸
D. GIn、CO₂
E. S腺苷蛋氨酸

正确答案：E。S腺苷蛋氨酸